蚓状肌
A. 起自指浅屈肌腱
B. 止于指背腱膜
C. 屈指骨间关节
D. 伸掌指关节
E. 屈腕关节

正确答案：B。止于指背腱膜

解析：蚓状肌起自指深屈肌腱，而非指浅屈肌腱（A错），止于指背腱膜（B对），伸指骨间关节，而非屈指骨间关节（C错），屈掌指关节，而非伸掌指关节（D错），不屈腕关节（E错）。